急性毒性试验观察周期一般为
A. 1天
B. 1周
C. 2周
D. 3周

正确答案：C。2周

解析：本题考查急性毒性试验的观察周期。急性毒性试验是评价化学物一般毒性作用的基础性实验，在短期内即可获得关于受试物毒作用的相关信息。急性毒性试验的观察周期应依据受试物的特殊性质、毒性反应、症状发生的时间和恢复期的长短等而定，一般应至少观察14天（C对ABD错）。